对喜树碱进行结构修饰得到的水溶性前药是
A. 喜树碱
B. 氟尿嘧啶
C. 环磷酰胺
D. 盐酸伊立替康
E. 依托泊苷

正确答案：D。盐酸伊立替康

解析：本题考查伊立替康。盐酸伊立替康（D对）是在喜树碱（A错）结构中引入羰酰基哌啶基哌啶侧链，可与盐酸成盐，得到水溶性药物。氟尿嘧啶（B错）是尿嘧啶代谢物类抗肿瘤药物。环磷酰胺（C错）是在氮芥类抗肿瘤药。依托泊苷（E错）为生物碱类拓扑异构酶Ⅱ的抑制剂。